子宫脱垂患者，宫颈及部分宫体脱出阴道口，应属
A. Ⅰ度轻
B. Ⅰ度重
C. Ⅱ度轻
D. Ⅱ度重
E. Ⅲ度重

正确答案：D。Ⅱ度重

解析：子宫脱垂分为3度：Ⅰ度（A错）轻型：宫颈外口距处女膜缘＜4cm，未达处女膜缘；重型（B错）：宫颈已达处女膜缘，阴道口可见宫颈。Ⅱ度轻型（C错）：宫颈脱出阴道口，宫体仍在阴道内；重型（D对）：宫颈及部分宫体脱出阴道口。Ⅲ度（E错）：宫颈与宫体全部脱出阴道口外。